患者，女，20岁。未行月经，体质虚弱，腰痠腿软，头晕耳鸣，舌质淡，苔少，脉沉弱。诊为闭经。治疗应首选
A. 育阴汤
B. 人参养荣汤
C. 一贯煎
D. 血府逐瘀汤
E. 苍附导痰丸

正确答案：A。育阴汤

解析：女子二十岁尚未行经，体质虚弱，腰痠腿软，头晕耳鸣，属先天禀赋不足，肝肾亏损，肾精未充，肝血虚少，治宜滋补肝肾，养血调经，方选育阴汤（A对）。人生养荣汤（B错）治疗气血两虚证之闭经。一贯煎（C错）主治肝郁肾虚证之月经紊乱。血府逐瘀汤（D错）治疗气滞血瘀证之闭经。苍附导痰丸（E错）主治痰湿阻滞之月经后期。